疾病流行指
A. 某疾病发病率虽然低，但在某地区或人群中确是常年不断
B. 罹患率大于10/1000
C. 某种疾病的发病率明显超过往年同期发病率水平
D. 呼吸系统疾病的季节性升高
E. 年发病率以十万分只几计算

正确答案：C。某种疾病的发病率明显超过往年同期发病率水平

解析：本题考查疾病流行的概念。流行是指在某地区某病的发病率显著超过该病历年发病率水平（C对ABDE错）。相对于散发，流行出现时各病例之间呈现明显的时间和空间联系。